右心衰竭的患者会出现颈静脉怒张这一特征性表现，颈静脉怒张是下列哪条静脉怒张
A. 颈外静脉
B. 颈内静脉
C. 锁骨下静脉
D. 颈前静脉
E. 面静脉

正确答案：A。颈外静脉

解析：颈静脉怒张是颈外静脉怒张（A对）。正常人立位或坐位时颈外静脉常不显露，平卧时可稍见充盈，充盈的水平仅限于锁骨上缘至下颌角距离的下2/3以内。在坐位或半坐位（身体呈45°）时，如颈静脉明显充盈、怒张或搏动，为异常征象，提示颈静脉压升高，见于右心衰竭、缩窄性心包炎、心包积液、上腔静脉阻塞综合征，以及胸腔、腹腔压力增加等情况。若平卧位时看不到颈静脉充盈，提示低血容量状态。